Ⅲ型卡环（适用于三型观测线）的特点是
A. 固位、稳定作用好，支持作用差
B. 固位、稳定、支持作用均好
C. 固位、稳定、支持作用均差
D. 固位、支持作用好，稳定性差
E. 稳定、支持作用均好，固位差

正确答案：D。固位、支持作用好，稳定性差

解析：本题考查Ⅲ型卡环的特点。Ⅲ型导线是近远中缺隙均有明显的倒凹或者基牙向颊、舌侧倾斜时所形成的导线，导线位置靠近（牙合）缘。Ⅲ型导线卡环为靠近（牙合）缘的高臂卡环，或用下返卡环臂，卡环臂端在倒凹区，卡环臂最好用弹性较大的不锈钢丝弯制而成。因此三型卡环固位、支持作用较好，稳定性差（D对）。固位、稳定、支持作用均好（B错）为Ⅰ型卡环的特点。